治疗潮热，盗汗，遗精，腰酸者，常应用熟地、山萸肉等，亦可选用
A. 黄芩
B. 黄连
C. 黄柏
D. 苦参
E. 龙胆草

正确答案：C。黄柏

解析：潮热，盗汗，遗精，腰酸是肾阴虚内热的表现，治疗除用滋肾阴之品外，还应清虚热，黄柏主入肾经，清泻相火、退骨蒸，此处配伍最宜（C对）。黄芩（A错）的功效是清热燥湿，泻火解毒，止血，安胎。黄连（B错）的功效是清热燥湿，泻火解毒。苦参的功效（D错）是清热燥湿，杀虫，利尿。龙胆草（E错）的功效是清热燥湿，泻肝胆火。